女，70岁，无牙颌。全口义齿修复过程中，确定颌位关系后采用外耳道触诊法检查时，感觉左侧髁突撞击明显，而右侧无感觉，如果该患者的颌位关系未重新确定，在试排牙时会出现
A. 垂直距离过低
B. 前牙覆盖过大
C. 右侧后牙覆盖大于左侧后牙
D. 前牙开（牙合）
E. 下颌义齿中线偏斜

正确答案：E。下颌义齿中线偏斜

解析：本题考查检查颌位关系。女，70岁，无牙颌。全口义齿修复过程中，确定颌位关系后采用外耳道触诊法检查时，感觉左侧髁突撞击明显，而右侧无感觉，如果该患者的颌位关系未重新确定，在试排牙时会出现下颌义齿中线偏斜（E对）。确定颌位关系后采用外耳道触诊法检查，左侧髁突撞击明显，而右侧无感觉，可能发生下颌偏斜。